可导致肝肾毒性、幼龄动物关节软骨毒性的药物是
A. 诺氟沙星
B. 泼尼松
C. 紫霉素
D. 美洛昔康
E. 头孢曲松

正确答案：A。诺氟沙星

解析：本题考查药物的不良反应。可导致肝肾毒性、幼龄动物关节软骨毒性的药物是诺氟沙星（A对）。诺氟沙星属于喹诺酮类抗菌药物，喹诺酮类抗菌药物可引起关节痛、关节肿胀及软骨损害，影响骨骼发育。泼尼松（B错）为糖皮质激素，静脉迅速给予大剂量可能发生全身性的过敏反应，包括面部、鼻黏膜、眼睑肿胀，荨麻疹，气短，胸闷，喘鸣。紫霉素（C错）为氨基糖苷类抗菌药物，具有耳肾毒性。活动性消化性溃疡，严重肝功能不全者，非透析严重肾功能不全者，儿童和年龄小于15岁的青少年，孕妇或哺乳者禁用美洛昔康（D错）。头孢曲松（E错）不得用于高胆红素血的新生儿和早产儿的治疗。如新生儿(≤28天）需要(或预期需要）使用含钙的静脉输液营养液治疗，则禁止使用头孢曲松，因为有产生头孢曲松-钙沉淀的危险。